下列哪一项是病例对照研究
A. 在不同阶层的人群中调查某病的患病率
B. 在戒烟和至今仍在抽烟的男子中调查肿瘤的相对危险度
C. 分析以往疾病在不同地区、不同条件下的分布，以便根据所研究疾病的各种因素积累的资料确立假设
D. 从已知病例组和对照组获得暴露史和其他资料，以比较病例组中各项特征或暴露情况的相对频率是否有统计学意义
E. 调查以往患病率的趋势，以便预测将来疾病的发生

正确答案：D。从已知病例组和对照组获得暴露史和其他资料，以比较病例组中各项特征或暴露情况的相对频率是否有统计学意义

解析：本题考查病例对照研究的概念。病例对照研究的基本原理是以当前已经确诊的患有某特定疾病的一组病人作为病例组，以不患有该病但具有可比性的一组个体作为对照组，通过询间、实验室检查或复查病史，搜集研究对象既往对各种可能的危险因素的暴露史，测量并采用统计学检验，比较病例组与对照组各因素暴露比例的差异是否具有统计学意义（D对ABCE错）。